突发事件发生后，应当及时向毗邻省自治区直辖市人民政府卫生行政部门通报的机构是
A. 国务院
B. 国务院卫生行政部门
C. 突发事件发生地的省自治区直辖市人民政府
D. 突发事件发生地的省自治区直辖市人民政府卫生行政部门
E. 国务院办公厅

正确答案：D。突发事件发生地的省自治区直辖市人民政府卫生行政部门

解析：突发事件发生后，突发事件发生地的省自治区直辖市人民政府卫生行政部门（D对），应当及时向毗邻省自治区直辖市人民政府卫生行政部门通报。